依据Poiseuille公式，关于滤过的错误表述是
A. 操作压力越大，滤速越快
B. 采用减压滤过法可提高滤速
C. 滤层越厚，滤速越慢
D. 溶液黏度越大，滤速越慢
E. 滤材中毛细管半径越小，滤速越快

正确答案：E。滤材中毛细管半径越小，滤速越快

解析：本题考查影响滤过的因素。依据Poiseuille公式，关于滤过的错误表述是滤材中毛细管半径越小，滤速越快（E错，为本题正确答案）。根据Poiseuille公式V=Pπr⁴t/8ηl，滤材中毛细管半径越小，滤速越慢。操作压力越大，滤速越快（A对）。采用减压滤过法可提高滤速（B对）。滤层越厚，滤速越慢（C对）。溶液黏度越大，滤速越慢（D对）。